巴氏消毒法主要杀灭食品中的
A. 芽孢
B. 繁殖型微生物
C. 非致病菌
D. 致病菌
E. 腐败菌

正确答案：B。繁殖型微生物